患者，男，68岁。有慢支病史10年。近半年间歇性下肢浮肿，朝轻暮重。X线提示慢支肺气肿、心脏轻度向两侧增大，ECG提示“肺型P波”，右心室肥大。诊断为肺心病伴右心衰。对其最具有诊断意义的体征是
A. 心浊音界向左下扩大
B. 两肺底有细湿啰音
C. 肝—颈静脉反流征(+)
D. 房颤伴快速心室率
E. 肝脾大

正确答案：C。肝—颈静脉反流征(+)

解析：患者肺心病伴右心衰，为肺心病肺、心功能失代偿期，主要表现为颈静脉怒张，心率增快，肝大且有压痛（E错），肝颈静脉回流征阳性（C对），下肢水肿，严重者可有腹水。患者右心室肥大，故心浊音界应向右下扩大（A错）。两肺底有细湿啰音（B错）出现在肺心病患者肺、心功能代偿期。房颤伴快速心室率（D错）可出现在各种心功能不全的患者，最常见于二尖瓣狭窄患者。